牙拔除后至少多长时间，拔牙创内形成凝血块而将创口封闭
A. 5分钟
B. 10分钟
C. 15分钟
D. 30分钟
E. 45分钟

正确答案：C。15分钟

解析：拔牙创出血及血凝块形成，拔牙后，拔牙创内充满的血液约于15～30分钟即可形成血凝块而将创口封闭。此血块的存在有保护创口、防止感染、促进创口正常愈合的功能，最佳的为30分钟。掌握“牙拔除术前准备、器械、心血管及拔牙愈合过程”知识点。